关于成人未孕子宫的形态，下列叙述不正确的
A. 呈前、后稍扁的梨形
B. 长约7~9cm
C. 分底、体、颈三部分
D. 子宫峡明显
E. 无

正确答案：D。子宫峡明显

解析：未妊娠时，子宫峡不明显（D错，为本题正确选项）；成人未孕子宫呈前后稍扁的梨形（A对），长约7 ~9cm（B对），分为底、体、颈三部分（C对）。